女，40岁。半月前头痛，恶心，呕吐2次，伴低热，问话不答。独自发呆，卧床不起，抽搐2次。査体：血压140/90mmHg，下肢肌张力增高，右侧巴氏征（+），脑电图：弥漫性δ波以额颈为主，有阵发性尖波发放。该患者的诊断为
A. 病毒性脑炎所致精神障碍
B. 精神分裂症
C. 脑肿瘤所致精神障碍
D. 癔症
E. 癫痫性精神障碍

正确答案：A。病毒性脑炎所致精神障碍

解析：该患者半月前头痛，恶心，呕吐2次，伴低热，问话不答、独自发呆（表现为言语减少，精神运动性抑制症状），査体：下肢肌张力增高，右侧巴氏征阳性，脑电图：弥漫性δ波以额颈为主，有阵发性尖波发放，故诊断为病毒性脑炎所致精神障碍（A对）。脑肿瘤所致精神障碍以智能障碍（注意力不集中、记忆力减退）为主，本例无此症状，故不考虑（C错）。癫痫性精神障碍脑电图可呈现额叶优势侧为主的弥漫性慢波或额叶部位棘波或尖波发放，与本例不符，故不考虑（E错）。